某男，66岁。长期吸烟，喘促气短20年，加重10天。症见喘促气短，动则尤甚，呼多吸少，气不得续，形寒肢冷，面唇青紫；舌质淡，苔薄，脉沉弱。其中医证候是
A. 风寒闭肺
B. 风热犯肺
C. 肺脾气虚
D. 肾不纳气
E. 肝气郁结

正确答案：D。肾不纳气

解析：本题考查的是喘证的辨证论治。症见喘促气短，动则尤甚，呼多吸少，气不得续，形寒肢冷，面唇青紫；舌质淡，苔薄，脉沉弱。其中医证候是喘证肾不纳气（D对）。喘即气喘、喘息。喘证是以呼吸困难、甚至张口抬肩、鼻翼扇动、不能平卧为特征的疾病。西医学的肺炎、支气管炎、肺气肿、肺源性心脏病、心源性哮喘以及癔病等发生呼吸困难时，可参考此内容辨证论治。（一）风寒闭肺（A错）证：【症状】喘咳气逆，呼吸急促，胸部胀闷，痰多色白稀薄而带泡沫，兼头痛鼻塞、无汗、恶寒、发热，舌苔薄白而滑，脉浮紧。（二）痰热壅肺证：【症状】喘咳气涌，胸部胀痛，痰稠黏色黄，或夹血痰，伴胸中烦闷、身热、有汗、口渴喜冷饮、咽干、面红、尿赤、便秘。舌质红，苔薄黄腻，脉滑数。（三）痰浊阻肺证：【症状】喘而胸满闷塞，甚则胸盈仰息，咳嗽，痰多黏腻色白，咳吐不利，兼有呕恶，食少，口黏不渴。舌苔白腻，脉滑或濡。（四）肾不纳气证：【症状】喘促日久，动则喘甚，呼多吸少，气不得续，小便常因咳甚而失禁，或尿后余沥，形瘦神疲，汗出肢冷，面唇青紫，或有跗肿，舌淡苔薄，脉沉弱；或见喘咳，面红烦躁，口咽干燥，足冷，汗出如油。舌红少津，脉细数。咳嗽风热犯肺（B错）证：【症状】咳嗽频剧，气粗，或咳声嗄哑，咳痰不爽，痰黏稠或稠黄，喉燥咽痛，口渴，鼻流黄涕，头痛，肢楚，恶风身热。舌边尖红，苔薄黄，脉浮数。肺脾气虚（C错）证，脾胃气虚、生化减少，而致肺气失养。临床可见久咳，痰多清稀，食欲减退，大便溏薄，四肢无力，舌淡脉弱等症。使用培土生金法，又称补养脾肺法，即通过补脾益气而补益肺气的治法。郁证肝气郁结（E错）证：【症状】精神抑郁，情绪不宁，胸部满闷，胸胁胀痛，痛无定处，胸闷嗳气，喜太息，不思饮食，大便不调，或秘或溏泄。舌苔薄或腻，脉弦。